属于高危策略的是
A. 游说进行烟草广告立法
B. 对高血压患者的全面监管
C. 在高危人群中定期检测HIV
D. 残疾患者中假肢、矫正器、轮椅等的应用
E. 定期对成年人进行心血管疾病危险因素评估

正确答案：E。定期对成年人进行心血管疾病危险因素评估

解析：本题考查高危策略。高危策略是对未来发病风险高的一小部分个体，针对致病危险因素采取有针对性的措施，降低危险暴露水平及其未来发病的风险。例如，定期对成年人进行心血管疾病危险因素评估（E对ABCD错）。